以下关于颌面部软组织肉瘤的描述，不正确的是
A. 呈实质性进行性肿大
B. 恶性程度高，易发生淋巴转移，预后差
C. 基本治疗方法为根治性广泛切除
D. 晚期大多侵犯骨质，引起骨质破坏
E. 对高度恶性及手术边缘阳性者，均应追加放疗

正确答案：B。恶性程度高，易发生淋巴转移，预后差

解析：肉瘤的淋巴结转移率较低，而血循转移的几率较高。掌握“肉瘤”知识点。